中西药不合理联用会降低疗效的是
A. 补中益气汤与抗胆碱酶药联用
B. 黄连解毒汤与降血脂药联用
C. 六君子汤与抗震颤麻痹药联用
D. 黄连与抗生素联用
E. 瓦楞子与酸性药物联用

正确答案：E。瓦楞子与酸性药物联用

解析：本题考查的是中西药不合理联用的例举。中西药不合理联用会降低疗效的是瓦楞子与酸性药物联用（E对）。碱性较强的中药及中成药，如瓦楞子、海螵蛸、朱砂等，不宜与酸性药物如胃蛋白酶合剂、阿司匹林等联用，以免因联用而使疗效降低。补中益气汤与抗胆碱酶药联用（A错）起协同增效作用。补中益气汤、葛根汤等具有免疫调节作用的中药与抗胆碱酯酶药联用，治肌无力疗效较好。黄连解毒汤与降血脂药联用（B错）起协同增效作用。黄连解毒汤、大柴胡汤等与抗动脉粥样硬化、降血脂药联用，可增强疗效。六君子汤与抗震颤麻痹药联用（C错）可降低不良反应。六君子汤等与抗震颤麻痹药联用，可减轻其胃肠道副作用，但也可能影响其吸收、代谢和排泄。黄连与抗生素联用（D错）可降低不良反应。黄连、黄柏、葛根等具有较强抗菌作用的中药与抗生素类药联用，可减少抗生素的不良反应。